原发性三叉神经痛首选的药物是
A. 氯硝西泮
B. 左乙拉西坦
C. 乙琥胺
D. 卡马西平
E. 托吡酯

正确答案：D。卡马西平

解析：三叉神经痛是原发性三叉神经痛的简称，表现为三叉神经分布区内短暂的反复发作性剧痛。临床首选药物治疗，卡马西平（D对）有效率高，常作为首选。左乙拉西坦（B错）、乙琥胺（C错）用于成人和儿童（4岁以上）癫痫患者部分性发作的加用治疗。氯硝西泮（A错）可用于控制各型癫痫，尤适用于失神发作、婴儿痉挛症、肌阵挛性发作。托吡酯（E错）是一种抗癫痫药。